《中国药典》规定，制药用水中的纯化水可用作
A. 皮肤用制剂的稀释
B. 滴眼剂容器的精洗
C. 口服溶液的溶剂
D. 注射浓溶液的稀释
E. 中药注射剂制备所用饮片的提取

正确答案：A、C、E。皮肤用制剂的稀释；口服溶液的溶剂；中药注射剂制备所用饮片的提取

解析：本题考查的是制药用水中纯化水的作用。《中国药典》规定，制药用水中的纯化水可用作皮肤用制剂的稀释（A对）、口服溶液的溶剂（C对）、中药注射剂制备所用饮片的提取（E对）。纯化水为饮用水经蒸馏法、离子交换法、反渗透法或其他适宜的方法制备的制药用水，不含任何附加剂。其质量应符合《中国药典》纯化水项下的规定。纯化水可作为配制普通药物制剂用的溶剂或试验用水；可作为中药注射剂、滴眼剂等灭菌制剂所用饮片的提取溶剂；口服、外用制剂配制用溶剂或稀释剂；非灭菌制剂用器具的精洗用水（B错）。也用作非灭菌制剂所用饮片的提取溶剂。纯化水不得用于注射剂的配制与稀释（D错）。滴眼剂属于灭菌制剂。